哪类牙齿不宜做干髓术
A. 乳切牙
B. 乳尖牙
C. 年轻恒牙
D. 乳磨牙
E. 成年恒磨牙

正确答案：C。年轻恒牙

解析：本题考查干髓术。年轻恒牙（C错，为本题的正确答案）不宜做干髓术。干髓术是去除感染的冠髓，保留干尸化的根髓，保存患牙的治疗方法。适用于成年人后牙（即根尖孔已发育完成，并已缩窄）（E对）、牙髓早期病变（即牙髓尚未化脓、坏死）不能保存活髓者；也适用于乳牙牙髓炎，牙根已形成，尚未发生吸收者（ABD对）；对于前牙及肉眼可看到冠髓坏死时，不宜行干髓术。